同一胚层分化成熟组织转化为另一成熟组织的过程称为
A. 化生
B. 机化
C. 分化
D. 再生
E. 增生

正确答案：A。化生

解析：同一胚层分化成熟组织转化为另一成熟组织的过程称为化生（A对）。机化（P21）（B错）是指组织和细胞损伤后，新生肉芽组织长入并取代坏死组织、血栓、异物等的过程。分化（C错）是指同一来源的细胞逐渐产生出形态结构、功能特征各不相同的细胞类群的过程。再生（P27）（D错）是指机体出现损伤时，以损伤周围的同种细胞对缺损进行修补恢复的过程。增生（P8）（A错）是指细胞有丝分裂活跃导致组织或器官内细胞数目增多的现象。